关于病毒与肿瘤发生的关系，哪项组合是错误的
A. EB病毒——鼻咽癌
B. 汉坦病毒——肺癌
C. 乙型肝炎病毒——原发性肝癌
D. 人乳头瘤病毒——子宫颈癌
E. 人嗜T细胞病毒——成人T细胞白血病

正确答案：B。汉坦病毒——肺癌